急进性肾小球肾炎病理类型
A. 微小病变肾病
B. 新月体性肾小球肾炎
C. 硬化性肾小球肾炎
D. 系膜增生性肾小球肾炎
E. 毛细血管内增生性肾小球肾炎

正确答案：B。新月体性肾小球肾炎

解析：急进性肾小球肾炎的病理类型为新月体性肾小球肾炎（B对）。微小病变肾病（A错）、硬化性肾小球肾炎（C错）、系膜增生性肾小球肾炎（D错）是肾病综合征的几种病理类型，毛细血管内增生性肾小球肾炎（E错）是急性肾小球肾炎的的病理类型。